每周给药1次，只能深部肌内注射，可治疗梅毒螺旋体感染的抗菌药物是
A. 哌拉西林他唑巴坦
B. 青霉素G
C. 苯唑西林
D. 苄星青霉素
E. 阿莫西林

正确答案：D。苄星青霉素

解析：本题考查抗菌药物。每周给药1次，只能深部肌内注射，可治疗梅毒螺旋体感染的抗菌药物是苄星青霉素（D对）。哌拉西林他唑巴坦（A错）适用于由耐哌拉西林、产β-内酰胺酶的金黄色葡萄球菌所致的中、重度医院获得性肺炎。青霉素G（B错）适用于溶血性链球菌、肺炎链球菌、对青霉素敏感（不产青霉素酶）金葡菌等革兰阳性球菌所致的感染以及破伤风、气性坏疽、流行性脑脊髓膜炎、鼠咬热、梅毒、淋病。苯唑西林（C错）可治疗甲氧西林敏感金葡菌引起的肺炎。阿莫西林（E错）主要用于敏感菌所致的泌尿生殖道感染、上呼吸道感染、皮肤软组织感染、下呼吸道感染、胆道感染、伤寒等。